以下选项不属于体征的是
A. 喉中痰鸣
B. 耳鸣
C. 太息
D. 肠鸣
E. 面色萎黄

正确答案：B。耳鸣

解析：该题考查体征。耳鸣，是指病人自觉耳内鸣响的症状，由病人主观感到的不适，属于症状范畴，不属于体征（B错，为本题正确答案）。喉中痰鸣是医生通过闻诊中的听声音所获取的体征（A对）。太息，又称叹息，指情志抑郁，胸闷不畅时发出的长吁或短叹声，是通过闻诊中听声音所得到的体征（C对）。肠鸣，是指气体或液体通过肠道而产生的一种气过水声或沸泡音，肠鸣声高时，患者或旁人可以直接听到，属于体征范畴（D对）。面色萎黄是指面色黄而枯槁无光，是医生通过望诊获得的客观征象，属于体征范畴（E对）。